有关甲氨蝶呤药物相互作用的说法，错误的是
A. 阿司匹林会减慢甲氨蝶呤的肾排泄
B. 丙磺舒会减慢甲氨蝶呤的肾排泄
C. 碳酸氢钠会减慢甲氨蝶呤的肾排泄
D. 与顺铂等肾毒性药物合用，可能减慢甲氨蝶呤的肾排泄
E. 氨基糖苷类药物可增加甲氨蝶呤的肾毒性

正确答案：C。碳酸氢钠会减慢甲氨蝶呤的肾排泄

解析：本题考查甲氨蝶呤药物相互作用。有关甲氨蝶呤药物相互作用的说法，错误的是碳酸氢钠会减慢甲氨蝶呤的肾排泄（C错，为本题正确答案）。甲氨蝶呤属弱酸性药，主要由肾小球滤过和肾小管分泌排泄。碳酸氢钠等碱性药物可碱化尿液，增加甲氨蝶呤及其代谢物的溶解度，加速排泄，减少毒性作用。弱酸性药如丙磺舒及水杨酸类，可竞争性地抑制甲氨蝶呤的肾小管分泌，减慢其排泄（AB对），使其维持高血浆浓度状态，易致中毒。降低肾血流的药物，如非甾体抗炎药和具有肾毒性药如顺铂等，可减慢甲氨蝶呤的排泄（D对），易导致严重的骨髓抑制。氨基糖苷类药可影响甲氨蝶呤的分布相，使甲氨蝶呤的血药消除率下降，产生明显的肾毒性（E对）。